下列属于唾液腺良性肿瘤的是
A. 急性唾液腺炎
B. 唾液腺结核
C. 流行性腮腺炎
D. 坏死性唾液腺化生
E. 嗜酸性腺瘤

正确答案：E。嗜酸性腺瘤

解析：嗜酸性腺瘤是由胞质内含大量特征鲜明的嗜伊红颗粒的上皮细胞（大嗜酸性粒细胞）构成的唾液腺良性肿瘤，又称大嗜酸性粒细胞腺瘤、大嗜酸性粒细胞瘤。掌握“沃辛瘤及嗜酸性腺瘤”知识点。